做频数表时，以组距为5，下列哪项组段划分正确
A. 0-，5-，10-，…
B. 0-5，5-10，10-，…
C. -5，-10，-15，…
D. 0-4，5-9，10-，…
E. 5-，7-，9-，…

正确答案：A。0-，5-，10-，…

解析：本题考查频数分布表的相关内容。除最后一组外，每个组段均包含组段的下限值，即下限为闭区间，上限为开区间（A对BCDE错）。